男，45岁。骑车时摔倒。左前臂可见皮肤破损、肿胀。查体：T36.5℃，P80次/分，R18次/分，BP120/80mmHg，双肺双肺呼吸音清，未闻及干湿啰音，心律齐，腹软，无压痛。血常规：Hb120g/L，WBC9.6×10⁹/L。X线提示左前桡骨中断骨折。其创伤按伤情分类是
A. 中度闭合伤
B. 轻度开放伤
C. 重度闭合伤
D. 中度开放伤
E. 轻度闭合伤

正确答案：D。中度开放伤

解析：中年男性患者，骑车时摔倒。左前臂可见皮肤破损（提示开放性伤口）、肿胀。查体：T36.5℃（正常腋温36～37℃），P80次/分（正常60～100次/分），R18次/分（正常值12～20次/分），BP120/80mmHg（正常值90～120/60～80mmHg），双肺呼吸音清，未闻及干湿啰音，心律齐，腹软，无压痛。血常规：Hb120g/L（男性正常值120g/L～160g/L），WBC9.6×10⁹/L（4.0～10×10⁹/L）。X线提示左前桡骨中段骨折。开放伤和闭合伤的根本区别在于是否有皮肤破损，皮肤完整无伤口者称闭合伤，有皮肤破损者称为开放伤。患者骑车时摔倒，左前臂可见皮肤破损，肿胀，因此该患者应为开放伤。中度闭合伤（A错），重度闭合伤（C错），轻度闭合伤（E错）不符题意。临床上一般将病人病情程度分为轻、中、重三度，轻度伤（B错）主要是局部软组织伤，暂时失去作业能力，但仍可坚持工作；中度伤主要是广泛软组织损伤、上下肢开放性骨折（X线提示该患者左前桡骨中段骨折，故该患者应为中度损伤）、肢体挤压伤等，需要手术，但无生命危险。重伤指危及生命或治愈有严重残疾者。综上所述，该患者应该为中度开放性损伤（D对）。